心源性休克为
A. 高阻力型休克
B. 低阻力型休克
C. 两者均有
D. 两者均无
E. 无

正确答案：C。两者均有

解析：心源性休克根据血流动力学的变化可分为两型:①低排高阻型（A对）：大多数患者表现为外周阻力增高，与血压下降，减压反射受抑而引起交感－肾上腺髓质系统兴奋和外周小动脉收缩有关；②低排低阻型（B对，C为本题正确答案）：少数患者表现为外周阻力降低，这可能是由于心肌梗死或心室舒张末期容积增大和压力增高，刺激了心室壁的牵张感受器，反射性抑制了交感中枢，导致外周阻力降低所致。